属甾体皂苷类化合物的是
A. 知母皂苷
B. 人参皂苷R
C. 龙胆苦苷
D. 雷公藤甲素
E. 甜菊苷

正确答案：A。知母皂苷

解析：本题考查的是知母的化学成分。属甾体皂苷类化合物的是知母皂苷（A对）。知母中的化学成分主要为甾体皂苷和芒果苷，还含有木脂素、甾醇、鞣质、胆碱等成分。《中国药典》上将知母皂苷BⅡ和芒果苷定为知母药材的质量控制成分，要求知母皂苷BⅡ含量不得少于3.0%，芒果苷的含量不得少于0.7%。饮片指标低于原药材，如蓝知母要求知母皂苷BⅡ含量不得少于2.0%，芒果苷含量不得少于0.40%。知母根茎中含皂苷约6%，其类型分别为螺甾烷醇类（如知母皂苷AⅢ等）、异螺甾烷醇类（如知母皂苷Ⅰ）和呋甾烷醇类（如知母皂苷BⅤ等）。人参皂苷R（B错）为人参的主要化学成分，属于三萜皂苷。人参含有皂苷、多糖和挥发油等多种化学成分，人参皂苷为人参的主要有效成分之一。《中国药典》以人参皂苷为指标成分对人参、红参和人参叶进行含量测定。其中，人参和红参的质量控制成分为人参皂苷Rg₁、人参皂苷Re和人参皂苷Rb₁。例如，要求人参中人参皂苷Rg₁和人参皂苷Re的总量不得少于0.30%，人参皂苷Rb₁不得少于0.20%。人参皂苷可以分为三类，分别是人参皂苷二醇型（A型）、人参皂苷三醇型（B型）和齐墩果烷型（C型）。（1）人参皂苷二醇型：人参皂苷二醇型包括人参皂苷Rb₁、人参皂苷Rc和人参皂苷Rd等。（2）人参皂苷三醇型：人参皂苷三醇型包括人参皂苷Re、人参皂苷Rf和人参皂苷Rg₁等。（3）齐墩果烷型：齐墩果烷型包括人参皂苷Ro等。A型、B型的皂苷元属于四环三萜，C型皂苷元则属于五环三萜。A型和B型皂苷元属达玛烷型，为达玛烯二醇的衍生物。龙胆苦苷（C错）为龙胆的化学成分，属于环烯醚萜苷。龙胆含有的主要有效成分为裂环环烯醚萜苷类化合物，如獐牙菜苷、獐牙菜苦苷和龙胆苦苷等。此外还含有生物碱、黄酮、香豆素及内酯等化合物。《中国药典》以龙胆苦苷为指标成分进行含量测定，龙胆中含量不得少于3.0%；坚龙胆中含量不得少于1.5%。雷公藤甲素（D错）为雷公藤的化学成分，属于二萜类化合物。雷公藤中主要化学成分为雷公藤甲素、雷公藤乙素和雷公藤红素等。雷公藤甲素为二萜类化合物，不是生物碱。甜菊苷（E错）为菊科植物甜叶菊叶中所含的甜味苷，属于四环二萜。